药用部位为干燥茎髓，纵剖面薄膜呈梯状排列的药材是
A. 石斛
B. 灯心草
C. 通草
D. 木通
E. 肉苁蓉

正确答案：C。通草

解析：本题考查的是通草药材的来源与性状鉴别。药用部位为干燥茎髓，纵剖面薄膜呈梯状排列的药材是通草（C对）。通草：【来源】为五加科植物通脱木的干燥茎髓。【性状鉴别】药材呈圆柱形。表面白色或淡黄色，有浅纵沟纹。体轻，质松软，稍有弹性，易折断。断面平坦，显银白色光泽，中部有直径0.3～1.5cm的空心或半透明圆形的薄膜，纵剖面薄膜呈梯状排列，实心者少见。气微，味淡。石斛（A错）：【来源】为兰科植物金钗石斛、霍山石斛、鼓槌石斛或流苏石斛的栽培品及其同属植物近似种的新鲜或干燥茎。【性状鉴别】药材鲜石斛：呈圆柱形或扁圆柱形。表面黄绿色，光滑或有纵纹，节明显，色较深，节上有膜质叶鞘。肉质多汁，易折断。气微，味微苦而回甜，嚼之有黏性。灯心草（B错）：【来源】为灯心草科植物灯心草的干燥茎髓。木通（D错）：【来源】为木通科植物木通、三叶木通或白木通的干燥藤茎。【性状鉴别】药材呈圆柱形，常稍扭曲。表面灰棕色至灰褐色，外皮粗糙而有许多不规则的裂纹或纵沟纹，具突起的皮孔。节部膨大或不明显，具侧枝断痕。体轻，质坚实，不易折断，断面不整齐，皮部较厚，黄棕色，可见淡黄色颗粒状小点，木部黄白色，射线呈放射状排列，髓小或有时中空，黄白色或黄棕色。气微，味微苦而涩。肉苁蓉（E错）：【来源】为列当科植物肉苁蓉或管花肉苁蓉的干燥带鳞叶的肉质茎。【性状鉴别】药材呈扁圆柱形，稍弯曲。表面棕褐色或灰棕色，密被覆瓦状排列的肉质鳞叶，通常鳞叶先端已断。体重，质硬，微有柔性，不易折断，断面棕褐色，有淡棕色点状维管束排列成波状环纹。气微，味甜、微苦。